解剖牙冠与牙根的分界线在组织学中的本质为
A. 牙冠
B. 牙根
C. 牙颈
D. 釉质牙骨质界
E. 釉质牙本质界

正确答案：D。釉质牙骨质界

解析：牙骨质和釉质在牙颈部相接处称是解剖牙冠与牙根的分界线，其组织学本质为釉质牙骨质界。掌握“牙的组成、分类、功能及牙位记录”知识点。